利多卡因抗心律失常的作用机制是
A. 提高心肌自律性
B. β受体阻断作用
C. 抑制K⁺外流和Na⁺内流
D. 促进K⁺外流和Na⁺内流
E. 改变病变区传导速度

正确答案：E。改变病变区传导速度